室内通风换气效果评价指标
A. 一氧化碳
B. 二氧化硫
C. 细菌总数
D. 二氧化碳
E. 甲醛

正确答案：D。二氧化碳

解析：本题考查评价居室空气清洁度常用的指标。室内CO₂（D对ABCE错）的浓度可反映室内有害气体的综合水平，也可反映室内通风换气的实际效果，在一定程度上可作为居室内空气污染的一个指标。